川贝母的药理作用有
A. 镇咳
B. 祛痰
C. 降血压
D. 松弛肠肌
E. 兴奋子宫

正确答案：A、B、C、D、E。镇咳；祛痰；降血压；松弛肠肌；兴奋子宫

解析：本题考查川贝母的药理作用。川贝母的药理作用有镇咳（A对）、祛痰（B对）、降血压（C对）、松弛肠肌（D对）、抗菌（E对）。川贝母【药理作用】1.与功效相关的主要药理作用：（1）镇咳、祛痰；（2）平喘；（3）抗菌。2.其他药理作用（1）对消化系统的影响，对肠肌有松弛作用。（2）对心血管系统的影响，引起血压下降。